某建筑保温材料厂男工，工龄25年。近日被诊断为肺间皮瘤。其可能接触的致癌物是
A. 铬酸盐
B. 氯甲醚
C. 联苯胺
D. 氯乙烯
E. 石棉

正确答案：E。石棉

解析：本题考查肺间皮瘤的诱因。间皮瘤分良性和恶性两类，石棉（E对ABCD错）接触与恶性间皮瘤有关，间皮瘤可发生于胸、腹膜，以胸膜最多见。恶性间皮瘤发生与接触石棉类型有关。石棉具有较强的致恶性间皮瘤潜能，可能与其纤维性状和多丝结构，容易断裂成巨大数量的微小纤维富集于胸膜有关。